网膜孔下界
A. 肝尾叶
B. 肝方叶
C. 十二指肠上部
D. 肝十二指肠韧带
E. 覆盖在下腔静脉表面的腹膜

正确答案：C。十二指肠上部

解析：肝尾状叶（A对）为网膜孔上界,肝方叶（B错）与网膜孔无关，十二指肠上部（C对）为下界,肝十二指肠韧带（D错）为前界,覆盖在下腔静脉表面的腹膜（E错）为后界。